配伍后增效的是
A. 单行
B. 相须
C. 相杀
D. 相恶
E. 相反

正确答案：B。相须

解析：本题考查的是七情配伍。配伍后增效的是相须（B对）。“七情配伍”，又称配伍七情、药物七情。即指单味中药配伍同用的七种情形。（1）单行（A错）：即应用单味药就能发挥预期治疗效果，不需其他药的辅助。（2）相须：即性能相类似的药物合用，可增强原有疗效。（3）相使：即性能功效有某种共性的两药同用，一药为主，一药为辅，辅药能增强主药的疗效。（4）相畏：即一种药物的毒烈之性，能被另一种药物减轻或消除。（5）相杀（C错）：即一种药物能减轻或消除另一种药物的毒烈之性。（6）相恶（D错）：即两药合用，一种药物能使另一种药物原有功效降低，甚至丧失。（7）相反（E错）：即两种药物合用，能产生或增强毒害反应。